与卡环臂固位力大小关系不密切的因素是
A. 卡环的形态、长短和粗细
B. 卡环材料的物理特性
C. 基牙倒凹的深度和坡度
D. 卡环的类型
E. 卡环的磨光度

正确答案：E。卡环的磨光度

解析：卡环固位臂与固位力的关系：卡环臂的形态、长短和粗细与固位力有密切关系。卡环的形态关系到其可达到的正压力，不同的卡环满足不同固位力的需要。在倒凹深度和坡度相同时，卡环臂与基牙摩擦作用点越远离卡环体肩部，对牙面产生的正压力越小，故通常认为卡环臂越长则固位力下降。卡环臂的粗细对正压力有影响，在相同的位移下，卡环臂越粗可达副的正压力越大，固位力越大。同时，卡环臂的断面形态也对固位力有影响，铸造的半圆形卡环臂纵向距离大于横向距离，在同样的位移下，纵向固位力强，而弯制的锻丝卡环则横向固位力强，与卡环的磨光度关系不大。掌握“局部义齿的设计”知识点。